奥美拉唑抑制胃酸分泌的机制是
A. 阻断H受体
B. 抑制胃壁细胞H⁺泵的功能
C. 阻断M受体
D. 阻断促胃液素（胃泌素）受体
E. 直接抑制胃酸分泌

正确答案：B。抑制胃壁细胞H⁺泵的功能